《红楼梦》中的林黛玉，其动作稳定缓慢，观察事物细致人微，敏感多疑，孤独多虑，情感体验深刻且持久。林黛玉的气质类型属于
A. 多血质
B. 黏液质
C. 胆汁质
D. 抑郁质
E. 兴奋质

正确答案：D。抑郁质